双层渗透泵片处方中的推动剂是
A. 醋酸纤维素
B. 氯化钠
C. 聚氧乙烯（相对分子质量20万～500万）
D. 硝苯地平
E. 聚乙二醇

正确答案：C。聚氧乙烯（相对分子质量20万～500万）

解析：本题考查渗透泵片。聚氧乙烯（C对）（相对分子质量20万～500万）具有强吸水性，可作为渗透泵片的推动剂。醋酸纤维素（A错）为膜控型片的衣膜材料。氯化钠（B错）为渗透压活性物质。硝苯地平（D错）为抗心绞痛药物，不作为辅料使用。聚乙二醇（E错）常用作包衣液中加入的的制孔剂。